胖人或痰湿内盛者易患眩晕中风的发病因素是
A. 地域因素
B. 气候因素
C. 体质因素
D. 生活工作环境
E. 精神状态

正确答案：C。体质因素

解析：先天禀赋是体质形成的重要因素，而体质的形成、发展与强弱在很大程度上又依赖于后天因素的影响，故体质是机体内外环境多种复杂因素共同作用的结果。先天因素包括父母禀赋和性别差异；后天因素是人出生之后各种因素的总和，如年龄、膳食、生活起居、劳逸、精神情志、自然社会环境因素、疾病损害、药物治疗等。胖人或痰湿内盛者易患眩晕中风是由体质决定的（C对），而地域、气候、生活工作环境、精神状态是可以影响体质的后天因素（ABDE错）。